根据行为改变阶段模式，如果某服务对象处在行为维持阶段，应该采取的干预措施是
A. 改变环境以消除或减少诱惑
B. 促使他们针对危险行为对自身、他人和环境的影响做出评判
C. 促使参与者做出改变行为的承诺
D. 促使他们进行思考，认识到危险行为的危害、权衡改变行为的利弊
E. 从情感上评估自己的健康风险行为对自身和环境的影像

正确答案：A。改变环境以消除或减少诱惑

解析：行为转变理论模式，也称为行为阶段转变理论模型（TTM），它着眼于行为变化过程及对象需求，理论基础是社会心理学。它认为人的行为转变是一个复杂、渐进、连续的过程，可分为5个不同的阶段，即没有准备阶段、犹豫不决阶段、准备阶段、行动阶段和维持阶段。在服务对象处于行为维持阶段，应采取的干预措施是改变环境以消除或减少诱惑，以更好得帮助患者顺利维持当前措施（A对）。